对于卫生服务提供者来讲，社会卫生状况评价的主要意义在于
A. 有利于科学地制定、改善社会卫生措施
B. 找出主要社会卫生问题、重点保护人群和重点防治对象
C. 动员有限的社会卫生资源
D. 了解社会经济环境现状
E. 了解卫生服务和卫生资源提供

正确答案：B。找出主要社会卫生问题、重点保护人群和重点防治对象